男，17岁，刷牙出血，前牙松动、移位1年，有时牙龈肿痛。如果要诊断为青少年牙周炎，还需要检查
A. 附着水平
B. 牙周袋深度
C. X线片
D. 咬合关系
E. 以上检查都要

正确答案：E。以上检查都要

解析：本题考查局限型侵袭性牙周炎的检查。青少年牙周炎在新分类中为侵袭性牙周炎，需检查附着水平以及牙周袋深度，确定牙周病变的程度，因为侵袭性牙周炎有严重而又快速的附着丧失（AB对）。局限型侵袭性牙周炎病变局限于第一磨牙和切牙，磨牙为弧形吸收，切牙为水平型骨吸收，可通过X线检测（C对）。病变早期出现牙齿松动和移位，在炎症不明显的情况下，患牙可出现松动和咀嚼无力，切牙可唇侧远中移位，呈扇形排列（D对），（ABCD均对，故E为本题的正确答案）。